患者，女，21岁，未婚，患有甲状腺功能亢进症，应用丙硫氧嘧啶150mg，tid治疗4个月后，出现体重增重、乏力、怕冷、突眼加重，治疗方案应调整为
A. 加大丙硫氧嘧啶用量
B. 丙硫氧嘧啶减量并加甲状腺素片
C. 换用另一种抗甲状腺药物
D. 放射性131I治疗
E. 手术治疗

正确答案：B。丙硫氧嘧啶减量并加甲状腺素片

解析：本题考查治疗甲状腺功能减退症药物。治疗方案应调整为丙硫氧嘧啶减量并加甲状腺素片（B对）。体重增加、乏力、怕冷症状是甲状腺功能减退症的临床表现，说明该患者在服用丙硫氧嘧啶的4个月中剂量过大，需将该药用量减少并同时加用甲状腺素片进行调整。加大丙硫氧嘧啶用量（A错）、换用另一种抗甲状腺药物（C错）、放射性¹³¹I治疗（D错）均会增加甲减症状，使病情加重。